以1岁为一个年龄组而编制的寿命表称为
A. 寿命表
B. 定群寿命表
C. 现时寿命表
D. 完全寿命表
E. 简略寿命表

正确答案：D。完全寿命表

解析：本题考查完全寿命表的分组。完全寿命表（D对ABCE错）的年龄组以每1岁为1组。